里热证见
A. 额上热甚于手心热
B. 手心热甚于额上热
C. 手足俱冷
D. 手足心热甚于手足背
E. 尺肤部凉

正确答案：B。手心热甚于额上热

解析：手心热与额上热比较，若手心热甚于额上热者为里热（B对）。手心热与额上热比较，若额上热甚于手心热者为表热（A错）。手足俱冷，为阳虚寒盛（C错）。手足心与手足背比较，手足心热甚于手足背，多为内伤发热（D错）。尺肤凉，而脉象细小者，多为泄泻、少气（E错）。